金瓷冠唇面龈缘宽度一般为
A. 0.5mm肩台
B. 1.0mm肩台
C. 1.2mm肩台
D. 1.5mm肩台
E. 1.8mm肩台

正确答案：B。1.0mm肩台

解析：本题考查烤瓷熔附金属冠。金瓷冠唇颊侧肩台宽度一般为1.0mm（B对）。若预备不足，要么颈部瓷层太薄，出现金属色或透明度降低，冠边缘的强度下降；要么为了保证强度而增加冠边缘突度，致使颈部外形与牙颈部不一致，冠颈部形成肿胀外观。若预备过多，可能会引起牙髓损害，因为颈部髓腔壁厚度一般为1.7～3.0mm。